抗高血压药的药理作用和临床评价
A. 盐酸普萘洛尔
B. 氯贝丁酯
C. 硝苯地平
D. 甲基多巴
E. 卡托普利

正确答案：E。卡托普利

解析：本题考查卡托普利。卡托普利（E对）为血管紧张素转化酶抑制剂，抑制血管紧张素Ⅰ转换成血管紧张素Ⅱ，并能抑制醛固酮分泌，减少水钠潴留，对多种类型高血压均有明显降压作用。盐酸普萘洛尔（A错）为β-受体阻断药，临床主要用于治疗β受体介导的心律失常。氯贝丁酯（B错）为苯氧乙酸类药物，具有降血脂作用，用于高甘油三酯血症、高胆固醇血症及混合型高血脂症。硝苯地平（C错）是二氢吡啶类钙拮抗剂，扩张冠状动脉和周围动脉作用最强，抑制血管痉挛效果显著，是变异型心绞痛的首选药物。甲基多巴（D错）属于中枢性降压药，在体内产生代谢产物阻断中枢α受体，从而抑制对心、肾和周围血管的交感冲动输出，使周围血管阻力降低，血压下降。